乳腺囊性增生用逍遥散加味治疗，其证型是
A. 肝郁气滞
B. 痰瘀凝结
C. 气滞血瘀
D. 冲任失调
E. 肝脾不和

正确答案：A。肝郁气滞

解析：乳腺囊性增生相当于中医的乳癖，逍遥散功能疏肝解郁，临床常加减用于治疗肝郁气滞型乳癖（A对）。痰瘀凝结证选用逍遥蒌贝散加减治疗（B错）。冲任失调证选用二仙汤合四物汤加减治疗（D错）。